按大气质量指数划分的大气质量级别中，大气质量指数为1.00～1.49，所代表的大气质量评语是
A. 中污染
B. 重污染
C. 轻污染
D. 尚清洁
E. 清洁

正确答案：C。轻污染

解析：本题考查大气质量评语。按大气质量指数划分的大气质量级别中，大气质量指数为1.00～1.49，所代表的大气质量评语是轻污染（C对ABDE错）。